间接固位体不包括
A. 尖牙支托
B. 前牙邻间钩
C. 卡环
D. 金属舌板
E. 金属腭板

正确答案：C。卡环

解析：本题考查间接固位体的种类。直接固位体是防止义齿（牙合）向脱位，起主要固位作用的固位部件如卡环（C错，为本题的正确答案）。间接固位体是用以辅助直接固位体的部件，常用的间接固位体有（牙合）支托（A对）、舌支托、连续卡环。而金属舌/腭板（DE对）、附加卡环、邻间钩（B对）、延伸基托等，除发挥本身特有作用外，根据设计需要，也可起到间接固位作用。